口腔扁平苔藓临床上主要表现为
A. 网纹状
B. 丘疹状
C. 斑状型
D. 溃疡型
E. 疱型

正确答案：A。网纹状

解析：本题考查口腔扁平苔藓与慢性盘状红斑狼疮。口腔扁平苔藓临床上主要表现为黏膜的白色或灰白色网状或线状条纹（A对）；舌黏膜主要表现为浅白色斑块。